患者，男，65岁。慢性支气管炎及高血压病史10年，近半年活动后自觉气短。检查：血压160/95mmHg（21.3/12.6kPa），心脏听诊未闻及器质性杂音，两肺听诊无异常，心电图及X线显示左心室增大。应首先考虑的是：
A. 冠心病
B. 高血压性心脏病
C. 风心病
D. 肺心病
E. 病毒性心肌炎

正确答案：B。高血压性心脏病

解析：本例患者为老年男性，有慢性支气管炎和高血压病史，近半年出现活动后气促，查体：血压160/95mmHg（正常值90～139/60～89,提示2级高血压），心肺听诊无异常，心电图及X线显示左心室增大，故诊断首先考虑的是高血压性心脏病（B对）。冠心病（A错）主要表现为胸骨后紧缩性痛，舌下含服硝酸甘油可缓解，部分患者查体可发现一过性第三心音或第四心音，心电图检查可有缺血性表现，X线检查一般不会有左心室增大。风心病（C错）以二尖瓣病变最为常见，其次为主动脉瓣，主要表现为呼吸困难，查体常可发现心脏杂音，X线表现与风心病受损瓣膜类型有关。肺心病（D错）主要表现为咳嗽、呼吸困难、活动后气促，严重者可出现呼吸衰竭和右心衰竭，查体可见三尖瓣区出现收缩期杂音和剑突下搏动增强，心电图和X线主要表现为右心室肥大。病毒性心肌炎（E错）患者多数在发病前1～3周有病毒感染前驱症状，如发热、倦怠等，随后可出现心悸、胸痛，查体常有心律失常，以房性与室性期前收缩及房室传导阻滞最为多见，听诊可闻及第三、第四心音或奔马律。